蛇床子不具有的功效是
A. 燥湿
B. 杀虫
C. 补肝明目
D. 散寒祛风
E. 温肾壮阳

正确答案：C。补肝明目

解析：本题考查的是蛇床子的功效。蛇床子不具有的功效是补肝明目（C错，为本题正确答案）。蛇床子：【功效】燥湿（A对）祛风（D对），杀虫（B对）止痒，温肾壮阳（E对）。补肝明目为枸杞子的功效。枸杞子：【功效】滋补肝肾，明目，润肺。